久用易产生耐受性的药物是
A. 硝酸甘油
B. 硝苯地平
C. 硝普钠
D. 普萘洛尔
E. 维拉帕米

正确答案：A。硝酸甘油